主治湿热痢疾的方剂是
A. 败毒散
B. 芍药汤
C. 白头翁汤
D. 葛根芩连汤
E. 真人养脏汤

正确答案：B。芍药汤

解析：主治湿热痢疾的是芍药汤，本方是由湿热壅滞肠中，气血失调所致。治以清热燥湿，调气和血（B对）。败毒散主治气虚，外感风寒湿表证（A错）。白头翁汤主治热毒痢疾（C错）。葛根芩连汤主治协热下利（D错）。真人养脏汤主治久泻久痢，脾肾虚寒证（E错）。